用二氧化碳为介质提取挥发油的方法
A. 分馏法
B. 超临界萃取法
C. 渗漉法
D. 压榨法
E. 升华法

正确答案：B。超临界萃取法

解析：本题考查中药有效成分的常用提取方法。用二氧化碳为介质提取挥发油的方法是超临界萃取法（B对）。超临界流体萃取技术是指在不改变化学组成的条件下，利用压力和温度的改变对超临界流体溶解能力的影响而进行高效提取的方法。可以作为超临界流体的物质很多，如二氧化碳、一氧化亚氮、六氟化硫、乙烷、庚烷、氨、二氯二氟甲烷等。分馏法（A错）：分馏法是利用液体混合物中各成分的沸点不同而进行分离的方法，通常分为常压分馏、减压分馏、分子蒸馏等，主要用于中药中挥发油和一些液体生物碱的分离。渗漉法（C错）：渗漉法是将中药粉末先装入渗漉器中用提取溶剂浸渍数小时，然后不断添加新溶剂，使其自上而下通过药物，从渗漉器下部流出，收集流出液（渗漉液）。压榨法（D错）：当某些中药中的有效成分含量比较高且存在于植物的汁液中时，可以将新鲜原料直接压榨，压出汁液再进行提取。升华法（E错）：有些固体物质受热后会直接汽化，遇冷后又凝固为原来的固体化合物，此现象被称为升华。